男性，30岁，右手中指受伤，3日后到医院就诊，查中指肿胀，发热，有波动感，最恰当的处理是
A. 热盐水浸泡患指
B. 抗菌药物静脉注射
C. 肌注度冷丁25毫克
D. 中指侧面纵形切口引流
E. 患指理疗

正确答案：D。中指侧面纵形切口引流